症见头痛经久不愈，痛处固定不移，痛如针刺，或有头部外伤史，舌紫，脉细。其治疗最佳方剂是
A. 桃红四物汤
B. 通窍活血汤
C. 血府逐瘀汤
D. 复元活血汤
E. 失笑散

正确答案：B。通窍活血汤

解析：头痛痛处固定，刺痛，舌紫等为瘀血头痛的典型表现，治宜活血化瘀，通窍止痛，代表方为通窍活血汤（B对）。桃红四物汤养血活血，主治血虚兼血瘀证（A错）。血府逐瘀汤或复元活血汤祛瘀通络，治疗瘀血阻络之胁痛（C、D错）。失笑散活血祛瘀，散结止痛，主治瘀血阻滞，胸脘疼痛，产后腹痛，痛经等（E错）。